依照国家对药品标签、说明书管理的要求，药品标签、说明书必须用中文显著标示药品的
A. 通用名称
B. 商品名称
C. 别名
D. 化学名称
E. 汉语拼音名称

正确答案：A。通用名称

解析：本题考查说明书和标签中药品名称的使用。依照国家对药品标签、说明书管理的要求，药品标签、说明书必须用中文显著标示药品的药品通用名称（A对）。说明书和标签中药品名称的使用：药品说明书和标签中标注的药品名称必须符合国家药品监督管理部门公布的药品通用名称和商品名称的命名原则，并与药品批准证明文件的相应内容一致。（1）药品通用名称：应当显著、突出，其字体、字号和颜色必须符合：①对于横版标签，必须在上三分之一范围内显著位置标出；对于竖版标签，必须在右三分之一范围内显著位置标出；除因包装尺寸的限制而无法同行书写的，不得分行书写。②不得选用草书、篆书等不易识别的字体，不得使用斜体、中空、阴影等形式对字体进行修饰。③字体颜色应当使用黑色或者白色，不得使用其他颜色。浅黑、灰黑、亮白、乳白等黑、白色号均可使用，但要与其背景形成强烈反差的要求。（2）药品商品名称（B错）：药品商品名称不得与通用名称同行书写，其字体和颜色不得比通用名称更突出和显著，其字体以单字面积计不得大于通用名称所用字体的二分之一。自2006年6月1日起，①新化学结构、新活性成分且在保护期、过渡期或者监测期内的药品；②在我国具有化合物专利，且该专利在有效期内的药品，可以申请使用商品名称。2006年6月1日前批准使用的商品名称可以继续使用。（3）注册商标：药品说明书和标签中禁止使用未经注册的商标以及其他未经国家药品监督管理部门批准的药品名称。药品标签使用注册商标的，应当印刷在药品标签的边角，含文字的注册商标，其字体以单字面积计不得大于通用名称所用字体的四分之一。3.药品说明书和标签的标识管理：麻醉药品、精神药品、医疗用毒性药品、放射性药品、外用药品和非处方药的标签、说明书，应当印有规定的标志。（1）麻醉药品等特殊管理药品标识与非处方药标识详见相关的章节。（2）外用药品标识为红色方框底色内标注白色“外”字，样式：外（见图8-1）。药品标签中的外用药标识应当彩色印制，说明书中的外用药品标识可以单色印制。